根据《药品召回管理办法》，药品召回的主体是
A. 药品监督管理部门
B. 药品研究机构
C. 药品上市许可持有人
D. 药品经营企业
E. 药品使用单位

正确答案：C。药品上市许可持有人

解析：本题考查的是药品召回的责任主体。根据《药品召回管理办法》，药品召回的主体是药品上市许可持有人（C对）。药品生产、经营企业和使用单位有关药品召回的义务：1.药品召回的责任主体：药品上市许可持有人是药品召回的责任主体。药品生产企业应当保存完整的购销记录，建立和完善药品召回制度，收集药品安全的相关信息，对可能具有安全隐患的药品进行调查、评估，召回存在安全隐患的药品。进口药品的境外制药厂商与境内药品生产企业一样也是药品召回的责任主体，履行相同的义务。进口药品需要在境内进行召回的，由进口的企业负责具体实施。2.销售与使用单位的职责：药品经营企业（D错）、使用单位（E错）发现其经营、使用的药品存在安全隐患的，应当立即停止销售或者使用该药品，通知药品生产企业或者供货商，并向药品监督管理部门（A错）报告。药品经营企业和使用单位应当建立和保存完整的购销记录，保证销售药品的可溯源性。在药品生产实施药品召回时，药品经营企业、使用单位应当协助药品生产企业履行召回义务，按照召回计划的要求及时传达、反馈药品召回信息，控制和收回存在安全隐患的药品。